声韧带的形成是
A. 甲状舌骨膜
B. 方形膜上缘
C. 弹性圆椎上缘
D. 方形膜下缘
E. 弹性圆锥下缘

正确答案：C。弹性圆椎上缘

解析：弹性圆锥上缘（C对）游离增厚，紧张于甲状软骨至声带突之间，称为声韧带。